同时服用消渴丸和格列本脲，出现低血糖反应属于
A. 剂型差错
B. 重复用药
C. 速率差错
D. 配制差错
E. 用法差错

正确答案：B。重复用药

解析：本题考查用药错误。同时服用消渴丸和格列本脲，出现低血糖反应属于重复用药（B对）。消渴丸中含格列本脲，与格列本脲同时服用属于重复用药。剂型差错（A错）、配置差错（D错）属于用药错误类型中的调剂错误。用法错误（E错）属于给药错误。速率差错（C错）属于处方错误。